麝香属于
A. 矿物类
B. 动物类
C. 真菌类
D. 裸子植物
E. 被子植物

正确答案：B。动物类

解析：本题考查的是麝香的来源。麝香属于动物类（B对）。麝香：【来源】为脊索动物门哺乳纲鹿科动物林麝、马麝或原麝成熟雄体香囊中的干燥分泌物。矿物类（A错）中药是指以天然矿物（朱砂、石膏、炉甘石、赭石）、矿物的加工品（轻粉、红粉、秋石）、动物或动物骨骼的化石（龙骨、石燕）入药的一类中药。真菌类植物（C错）即菌类中药。菌类中药：药用部位主要为真菌的菌核（茯苓、猪苓、雷丸）、子实体（灵芝、马勃）或子座与幼虫尸体的复合体（冬虫夏草）的中药，称为菌类中药。裸子植物（D错）与被子植物（E错）属于植物类中药。植物类中药是指植物的地上和地下部分的全体或某一部分供药用的一类中药。按入药部位可分为根及根茎类、茎木类、皮类、叶类、花类、果实种子类、全草类、藻菌地衣类、树脂类和其他类中药。